子宫肌瘤最常见的并发症是
A. 红色变性
B. 继发性贫血
C. 浆膜下肌瘤蒂扭转
D. 肌瘤压迫输尿管引起肾盂积水
E. 肌瘤恶变

正确答案：B。继发性贫血

解析：子宫肌瘤时由于患者长期月经过多可导致继发性贫血，出现乏力、心悸等症状。掌握“子宫肌瘤”知识点。